油相为液状石蜡，干胶法制备初乳，油、水、胶的比例是
A. 5:2:1
B. 4:2:1
C. 3:2:1
D. 2:2:1
E. 1:2:1

正确答案：C。3:2:1